对乙酰氨基酚的临床应用
A. 感冒发热
B. 痛风
C. 心律失常
D. 高血压
E. 风湿性关节炎

正确答案：A。感冒发热

解析：本题考查对乙酰氨基酚的临床应用。对乙酰氨基酚为解热镇痛药，临床用于感冒发热（A对）、关节痛、头痛、神经痛和肌肉痛等。